关于乳糜池，以下叙述不正确的是
A. 通常位于第1腰椎体前方
B. 为胸导管起始部的膨大
C. 由左、右腰干和l条肠干合成
D. 池内的淋巴液澄清透明
E. 得名与肠干来源的淋巴液性状密切相关

正确答案：D。池内的淋巴液澄清透明

解析：乳糜池通常位于第1腰椎体前方（A对），为胸导管起始部的膨大（B对），由左、右腰干和l条肠干合成（C对），自小肠绒毛中的中央乳糜池至胸导管的淋巴管道中的淋巴因含乳糜微粒呈白色（D错，为本题正确答案），所以称之为乳糜池，即得出其得名与肠干来源的淋巴液性状密切相关（E对）。